可引起二重感染的药物是
A. 链霉素
B. 羧苄青霉素
C. 头孢菌素
D. 林可霉素
E. 红霉素

正确答案：C。头孢菌素

解析：第二代、第三代头孢菌素有出现二重感染的危险，临床应严格掌握其适应证（C对）。